下列疾病中最适用心理治疗的是
A. 神经衰弱
B. 抑郁症
C. 躁狂症
D. 精神分裂症
E. 精神发育迟滞

正确答案：A。神经衰弱

解析：心理治疗是一种以助人为目的的专业性人际互动过程。通过言语和非言语的方式影响患者或其他来访者，可引起心理、行为和躯体功能的积极变化，达到治疗疾病、促进康复的目的。神经症是心理治疗的主要适应症，神经衰弱在中国属于神经症的诊断之一，是由于长期处于紧张和压力下，出现精神易兴奋和脑力易疲乏现象，常伴有情绪烦恼、易激惹、睡眠障碍、肌肉紧张性疼痛等，最主要的是，这些症状不能归于脑、躯体疾病及其他精神疾病，因而，心理治疗是其首要的疗法（A对），药物为辅。